某男，85岁。患糖尿病20年，刻下属阴阳两虚之消渴。宜选用的药是
A. 黄精
B. 沙苑子
C. 核桃仁
D. 菟丝子
E. 益智仁

正确答案：D。菟丝子

解析：本题考查菟丝子的主治病证。宜选用的药是菟丝子（D对）。菟丝子【功效】补阳益阴，固精缩尿，明目止泻，安胎，生津。【主治病证】（1）肾虚之腰膝酸痛、阳痿、滑精、尿频、白带过多。（2）肝肾不足之目暗不明。（3）脾虚便溏或泄泻。（4）肾虚之胎漏、胎动不安。（5）阴阳两虚之消渴。黄精（A错）【功效】滋阴润肺，补脾益气。【主治病证】（1）肺虚燥咳，劳嗽久咳。（2）肾虚精亏之腰膝酸软、须发早白、头晕乏力。（3）气虚倦怠乏力，阴虚口干便燥。（4）气阴两虚，内热消渴。沙苑子（B错）【功效】补肾固精，养肝明目。【主治病证】（1）肾虚腰痛，阳痿遗精，遗尿尿频，白带过多。（2）肝肾亏虚之目暗不明、头昏眼花。核桃仁（C错）【功效】补肾，温肺，润肠。【主治病证】（1）肾虚之腰痛脚弱，阳痿遗精。（2）肺肾两虚之咳喘。（3）肠燥便秘。益智仁（E错）【功效】暖肾固精缩尿，温脾止泻摄唾。【主治病证】（1）肾气虚寒之遗精滑精、遗尿、夜尿频多。（2）脾寒泄泻，腹中冷痛，脾虚口多涎唾。